根据《关于建立国家基本药物制度的实施意见》，关于基本药物使用的说法，正确的是
A. 政府举办的所有医疗机构全部配备和使用国家基本药物
B. 政府举办的基层医疗卫生机构优先配备和使用国家基本药物
C. 政府举办的医疗机构可不配备基本药物
D. 基本药物全部纳入甚本医疗保障药品报销目录
E. 基本药物报销比例可略高于非基本药物

正确答案：D。基本药物全部纳入甚本医疗保障药品报销目录

解析：本题考查的是《关于建立国家基本药物制度的实施意见》。根据《关于建立国家基本药物制度的实施意见》，关于基本药物使用的说法，正确的是基本药物全部纳入甚本医疗保障药品报销目录（D对）。基本药物全部纳入基本医疗保障药品报销目录，报销比例明显高于非基本药物（E错）。建立基本药物优先和合理使用制度。政府举办的基层医疗卫生机构全部配备和使用国家基本药物（AB错）。在建立国家基本药物制度的初期，政府举办的基层医疗卫生机构确需配备、使用非目录药品，暂由省级人民政府统一确定，并报国家基本药物工作委员会备案（C错）。配备使用的非目录药品执行国家基本药物制度相关政策和规定。其他各类医疗机构也要将基本药物作为首选药物并达到一定使用比例，具体使用比例由卫生行政部门确定。